治疗肺炎球菌肺炎的首选药物是
A. 磺胺类药物
B. 链霉素
C. 青霉素
D. 庆大霉素
E. 四环素

正确答案：C。青霉素